急性阑尾炎时，Mcburney点有明显压痛，此点位置应在
A. 脐与右髂前上棘连线的中外1/3交点处
B. 脐与右髂前上棘连线的中内1/3交点处
C. 两侧髂前上棘连线的右侧中外1/3交点处
D. 两侧髂结节连线的右侧中外1/3交点处
E. 脐与右侧髂前上棘连线的中点处

正确答案：A。脐与右髂前上棘连线的中外1/3交点处

解析：McBurney点位于脐与右髂前上棘连线的中外1/3交点处(A对)。